心肌收缩力加强，导致静脉回心血量增加的机制是
A. 动脉血压升高
B. 血流速度快
C. 心缩期室内压较低
D. 心舒期室内压较低
E. 静脉血流阻力下降

正确答案：D。心舒期室内压较低